桑叶除疏散风热外，又能
A. 凉血止血
B. 敛肺止咳
C. 利咽透疹
D. 清热解毒
E. 解肌退热

正确答案：A。凉血止血

解析：本题考查的是桑叶的功效。桑叶除疏散风热外，又能凉血止血（A对）。桑叶：【功效】疏散风热，清肺润燥，平肝明目，凉血止血。强力枇杷露：【功能】清热化痰，敛肺止咳（B错）。薄荷：【功效】宣散风热，清利头目，利咽，透疹（C错），疏肝。菊花：【功效】疏散风热，平肝明目，清热解毒（D错）。葛根：【功效】解肌退热（E错），透疹，生津，升阳止泻。